阴痒之肝经湿热证，治疗宜选
A. 五味消毒饮
B. 仙方活命饮
C. 知柏地黄丸
D. 龙胆泻肝汤
E. 加味五苓散

正确答案：D。龙胆泻肝汤

解析：阴痒湿热下注证的主要证候为阴部瘙痒灼痛,带下量多,色黄如脓,稠黏臭秽,头晕目眩,口苦咽干,心烦不宁,便秘溲赤；舌红,苔黄腻,脉弦滑而数。治宜泻肝清热,除湿止痒。方药选龙胆泻肝汤酌加虎杖、苦参（D对）。